慢性阻塞性腮腺炎的病理特征
A. 导管扩张
B. 排空迟缓
C. 腺泡肿大
D. 巨细胞浸润
E. 结缔组织纤维化

正确答案：A。导管扩张

解析：导管扩张、腺泡萎缩、导管腔内分泌物潴留是慢性阻塞性腮腺炎的主要病理特征。掌握“慢性阻塞性腮腺炎”知识点。